严重高钾血症时
A. 神经肌肉兴奋性降低
B. 心肌兴奋性降低
C. 两者均有
D. 两者均无
E. 无

正确答案：C。两者均有

解析：轻度高钾血症时由于细胞外液钾浓度增高，静息期细胞内钾外流减少，使Em绝对值减少，与Et间距离缩短而兴奋性增高。重度高钾血症时因Em值过小，细胞膜上的快钠通道失活，细胞处于去极化阻滞状态而不能兴奋，故神经肌肉兴奋性与心肌兴奋性降低（AB对，故C为本题正确答案）。